银汞合金的主要成份是
A. 银、锡、铜、锶
B. 银、锡、铁、锌
C. 银、锡、铜、锌
D. 银、锡、铜、铅

正确答案：C。银、锡、铜、锌

解析：本题考查银汞合金的主要成份。银汞合金由银合金粉与汞反应形成。银合金粉有两种类型：低铜银合金粉和高铜银合金粉，它们与汞反应生成低铜银合金和高铜银合金。合金粉主要由银、锡、铜、锌（C对）组成。